石决明入汤剂宜
A. 先煎
B. 后下
C. 研末冲服
D. 包煎
E. 同煎

正确答案：A。先煎

解析：石决明入汤剂宜先煎（A对），是由于石决明属于贝壳类药物，质地较为坚硬，先煎可以使有效成分充分析出。需后下（B错）的药多为气味芳香的药物，久煎其有效成分易于挥发而降低药效，如薄荷、青蒿、砂仁、沉香、白豆蔻、草豆蔻等，此外一些中药的有效成分久煎会被破坏，这类中药也应后下，如钩藤、大黄、番泻叶。需研末冲服（C错）多为用量较轻的贵重药，如麝香、牛黄、珍珠、羚羊角等；某些药物，为提高药效，也常研末冲服，如三七、花蕊石、白及、蜈蚣、全蝎、僵蚕、地龙、海螵蛸、瓦愣子、海蛤壳、延胡索等；某些药物高温容易破坏药效或有效成分难溶于水，也只能做散剂冲服，如雷丸、鹤草芽、朱砂；此外，还有一些液体药物也需要冲服，如竹沥汁、姜汁、藕汁、荸荠汁、鲜地黄汁。需包煎（D错）的药多为黏性强、粉末状及药材表面带有绒毛的药物，如蛤粉、滑石、旋覆花、车前子、蒲黄、灶心土等。同煎（E错）即为一般的煎煮方法，两味及两味以上药材共同煎煮。